初产妇，26岁。孕39周，肛查宫口8cm，先露S=0，胎膜未破，头先露，有宫缩，但子宫体部不变硬，持续时间30秒，间隔5分钟，胎心136次/分，B型超声示胎儿双顶径为9.0cm。此病例最适宜的处理是
A. 人工破膜
B. 立即剖宫产
C. 静脉点滴催产素5U
D. 肌注度冷丁100mg
E. 观察2小时后再决定

正确答案：A。人工破膜

解析：青年初产妇，孕39周，肛查宫口8cm（活跃期为宫口扩张3～10cm），子宫体部不变硬，持续时间30秒（正常为50～60秒），间隔5分钟（正常为2～3分钟），可考虑为第一产程协调性宫缩乏力（宫缩持续时间短，间歇期长且不规律）。本例胎膜未破，宫口扩张≥3cm、无头盆不称、胎头已衔接而产程延缓者，可首先人工破膜以加速产程（A对E错）；若观察半小时产程仍无进展，可静脉点滴催产素（C错）。剖宫产（B错）仅用于经上述处理后产程仍无进展或出现胎儿窘迫征象者。肌注哌替啶（杜冷丁）（P190）（D错）主要用于非协调性宫缩乏力的治疗。